一位病人患左眼内斜视、左侧面部表情肌瘫痪、左耳听觉过敏，左侧舌前2／3味觉丧失。此外，左眼眨眼反射消失和左眼少泪，并伴有右半身上运动神经元瘫痪。下列与面神经功能丧失无关的临床症状是
A. 面部表情肌瘫痪
B. 听觉过敏
C. 舌后1／3味觉丧失
D. 眨眼反射消失
E. 泪腺分泌减少

正确答案：C。舌后1／3味觉丧失

解析：因面神经的分支有管内、管外之分，故面神经损伤部位不同，表现出不同的症状。面神经管外损伤主要表现为损伤侧表情肌瘫痪（A对），如口角偏向健侧、不能鼓腮；说话时唾液从口角流出；伤侧额纹消失、鼻唇沟变平坦；眼轮匝肌瘫痪使闭眼困难、角膜反射消失、眨眼反射消失（D对）、泪腺分泌减少（E对）等症状，面神经功能丧失会使舌前2／3味觉丧失（C错，为本题正确选项）。